咽鼓管圆枕后方为
A. 梨状隐窝
B. 咽隐窝
C. 咽鼓管咽口
D. 扁桃体窝
E. 咽峡

正确答案：B。咽隐窝

解析：咽鼓管圆枕后方与咽后壁间有咽隐窝(B对)，梨状隐窝(A错)位于喉咽，咽鼓管咽口(C错)位于鼻咽部两侧壁上，扁桃体窝(D错)位于口咽部，咽峡(E错)为口咽与口腔的界限。